以下说法正确的是
A. HBV不同亚型之间没有交叉免疫，免疫后各亚型之间不能交叉保护
B. 我国乙型肝炎发病率在30~39岁有一高峰，因此，我国HBV感染者以成年为主
C. 乙型肝炎发病率有周期性起伏现象和明显的季节高峰
D. 乙型肝炎患者、HBsAg和HBeAg携带者均呈明显的家庭聚集性现象
E. 乙型肝炎主要通过粪-口途径传播

正确答案：D。乙型肝炎患者、HBsAg和HBeAg携带者均呈明显的家庭聚集性现象